患者，女，18岁。半年前失恋后精神抑郁，时喃喃自语，哭笑无常，痰多胸闷，舌苔白腻，脉弦滑，临床诊断最有可能的是
A. 痰迷心窍证
B. 肝气郁结证
C. 心火亢盛证
D. 痰火扰心证
E. 胆郁痰扰证

正确答案：A。痰迷心窍证

解析：因肝失疏泄，气郁生痰，蒙蔽心神，则见精神抑郁，喃喃自语，哭笑无常；痰阻胸阳，胃失和降，则痰多胸闷；舌苔白腻，脉弦滑，均为痰迷心窍之证（A对）。肝气郁结证指肝失疏泄，气机郁滞，以情志抑郁、胸胁、少腹胀痛及气滞症状为主要表现的证（B错）。心火亢盛证是指心火内炽，扰神迫血，火热上炎下移，以心烦失眠、舌赤生疮、吐衄、尿赤及火热症状为主要表现的证（C错）。痰火扰心证是指火热痰浊交结，扰乱心神，以狂躁、神昏及痰热症状为主要表现的证（D错）。胆郁痰扰证是指痰热内扰，胆气不宁，以胆怯易惊、心烦失眠及痰热症状为主要表现的证（E错）。